不属于变异指标的是
A. 中位数
B. 标准差
C. 全距
D. 四分位间距
E. 变异系数

正确答案：A。中位数

解析：离散趋势指标是反映一组同质观察值的变异程度。常用的描述变异程度的统计指标包括极差、四分位数间距、方差、标准差和变异系数。掌握“定量资料的统计描述和推断”知识点。